患者，男，24岁，诉右下后牙冷热刺激痛夜间痛3天。检查，右下第三磨牙近中低位阻生，右下78之间较多的食物嵌塞，右下8未探及龋坏，远中有肓袋略红肿，触疼痛。冷（-）。探及右下7远中颈部龋，探深，质软，冷刺激引发剧痛。首诊最佳处理为
A. 拔除右下8
B. 右下8冠周冲洗
C. 右下7开髓引流
D. 右下7去腐后ZOE安抚
E. 静滴广谱抗生素

正确答案：C。右下7开髓引流

解析：本题考查应急处理-开髓引流。患者，男，24岁，诉右下后牙冷热刺激痛夜间痛3天。检查，右下第三磨牙近中低位阻生，右下78之间较多的食物嵌塞，右下8未探及龋坏，远中有肓袋略红肿，触疼痛。冷（-）。探及右下7远中颈部龋，探深，质软，冷刺激引发剧痛。首诊最佳处理为右下7开髓引流（C对）。右下7已有症状，冷刺激引发剧烈疼痛，为防止其急性发作，即急性牙髓炎的症状，应尽早开髓引流，然后进行右下8的冠周冲洗（B错）。